外用治外伤出血的药是
A. 芡实
B. 椿皮
C. 赤石脂
D. 山茱萸
E. 覆盆子

正确答案：C。赤石脂

解析：本题考查的是赤石脂的主治病证。外用治外伤出血的药是赤石脂（C对）。赤石脂：【主治病证】（1）泻痢不止，便血脱肛。（2）崩漏，赤白带下。（3）湿疮流水，溃疡不敛，外伤出血。芡实（A错）：【主治病证】（1）脾虚久泻不止。（2）肾虚遗精，小便不禁，白带过多。椿皮（B错）：【主治病证】（1）久泻久痢，湿热泻痢，便血。（2）崩漏，赤白带下。（3）蛔虫病。（4）疮癣作痒。山茱萸（D错）：【主治病证】（1）肝肾亏虚之头晕目眩、腰膝酸软、阳痿。（2）肾虚之遗精、滑精，小便不禁，虚汗不止。（3）妇女崩漏及月经过多。覆盆子（E错）：【主治病证】（1）肾虚不固之遗精滑精、遗尿尿频。（2）肾虚阳痿。（3）肝肾不足之目暗不明。